男孩，1岁。发热伴咳嗽、气促7天。自出生后喂养困难，生长发育落后，多次患肺炎，查体：T38℃，P120次/分，R50次/分。消瘦，呼吸急促，双肺可闻及细湿啰音，胸骨左缘上方闻及粗糙响亮的收缩期杂音。腹软，肝肋下3cm，质中，脾肋下未触及，手指甲床可见毛细血管搏动。该患儿手指甲床毛细血管搏动是由于
A. 动脉收缩压降低
B. 动脉舒张压升高
C. 动脉收缩压升高
D. 动脉舒张压降低
E. 肺动脉向主动脉分流

正确答案：D。动脉舒张压降低

解析：由患儿胸骨左上缘闻及粗糙响亮的收缩期杂音的特征，以及患儿肝稍大、毛细血管搏动症的特异表现，可诊断为动脉导管未闭。手指甲床毛细血管搏动症是指用手指轻压手指末端，可使局部发白，当心脏收缩时则局部又发红，随心动周期局部发生有规律的红白交替的现象。当舒张压降低，脉压增宽时，可以出现手指甲床毛细血管搏动症（D对）。